《医疗机构制剂注册管理办法》在使用中发现新的不良反应时，应该
A. 立即销毁
B. 记录新的不良反应
C. 向药品监督管理局报告
D. 保留相关病历
E. 保留相关检验、检查报告

正确答案：C。向药品监督管理局报告

解析：本题考查药品新不良反应的处理。《药品不良反应报告和监测管理办法》第二十一条  药品生产、经营企业和医疗机构发现或者获知新的、严重的药品不良反应应当在15日内报告（C对），其中死亡病例须立即报告；其他药品不良反应应当在30日内报告。有随访信息的，应当及时报告。